关于HLA-Ⅱ类分子，正确的是
A. 由α链和β₂m链组成
B. 提呈外源性抗原
C. 分布在所有有核细胞的表面
D. 由HLA-A、B、C等基因编码
E. 可与CD8分子结合

正确答案：B。提呈外源性抗原